杜仲的功效为
A. 祛风湿，补肝肾，强筋骨，安胎
B. 祛风湿，强筋骨，利水消肿
C. 补肝肾，强筋骨，安胎
D. 补肝肾，行血脉，续筋骨，安胎止漏
E. 补肝肾，强筋骨，祛风湿

正确答案：C。补肝肾，强筋骨，安胎

解析：杜仲甘温而补，入肝、肾经，药力颇强。善温补肝肾而强筋健骨、安胎，兼降血压。既为治肾虚腰膝酸痛或筋骨无力之要药，又为治肝肾亏虚胎漏或胎动之佳品（C对）。功效为祛风湿，补肝肾，强筋骨，安胎（A错）的中药是桑寄生。功效为祛风湿，强筋骨，利水消肿（B错）的中药为五加皮。功效为补肝肾，行血脉，续筋骨，安胎止漏（D错）的中药是续断。功效为补肝肾，强筋骨，祛风湿（E错）的中药为狗脊。